男孩，3岁，出生时正常，母乳喂养，5个月后智能渐落后，头发变黄，肤色变白，有时发生抽搐，肌张力较高。假如该患儿刚出生不久，为早期诊断，应选择的检查项目是
A. 尿2，4-二硝基苯肼试验
B. 尿三氯化铁试验
C. Guthrie细菌生长抑制试验
D. 血T₃、T₄、TSH测定
E. 染色体核型分析

正确答案：C。Guthrie细菌生长抑制试验

解析：该患儿出生时正常，5个月后智能渐落后，头发变黄，肤色变白，有时发生抽搐，肌张力较高，可诊断为苯丙酮尿症。苯丙酮尿症新生儿筛查多采用Guthrie细菌生长抑制试验（C对）以测定血液中苯丙氨酸（Phe）浓度。尿2，4-二硝基苯肼试验、尿三氯化铁试验均适用于较大儿童的筛查（AB错）。血T3、T4、TSH测定适用于先天性甲状腺功能低下（P429）的患儿（D错）。染色体核型分析可用于检测基因突变但不作为早期诊断首选（E错）。